不得加工成中药制剂的是
A. 道地药材
B. 鲜用药材
C. 野生或半野生药用动植物
D. 自采自种自用中草药

正确答案：D。自采自种自用中草药

解析：本题考查的是中药材自种、自采、自用的管理规定。不得加工成中药制剂的是自采自种自用中草药（D对）。中药材自种、自采、自用的管理规定：自种、自采、自用中草药是指乡村中医药技术人员自己种植、采收、使用，不需特殊加工炮制的植物中草药。《中共中央国务院关于进一步加强农村卫生工作的决定》提出了在规范农村中医药管理和服务的基础上，允许乡村中医药技术人员自种、自采、自用中草药的要求。《中医药法》规定，在村医疗机构执业的中医医师、具备中药材知识和识别能力的乡村医生，按照国家有关规定可以自种、自采地产中药材并在其执业活动中使用。根据当地实际工作需要，乡村中医药技术人员自种自采自用的中草药，只限于其所在的村医疗机构内使用，不得上市流通，不得加工成中药制剂。道地药材（A错）：源自特定产区、具有独特药效，需要在特定地域内生产。鲜用药材（B错）：可采用冷藏、砂藏、罐贮、生物保鲜等适宜的保鲜方法，尽可能不使用保鲜剂和防腐剂。野生或半野生药用动植物（C错）的采集应坚持“最大持续产量”原则，“最大持续产量”即不危害生态环境，可持续生产（采收）的最大产量。